呼吸肌完全松弛时的肺容量等于
A. 余气量
B. 肺活量
C. 功能余气量
D. 用力肺活量
E. 肺泡通气量

正确答案：C。功能余气量